患者一上前牙牙冠1/2缺损，要求修复。以下哪项是初诊时问诊不必涉及的内容
A. 就诊的主要原因
B. 要求解决的主要问题
C. 缺损的原因
D. 曾经接受过的检查和治疗
E. 是否还能吃饭

正确答案：E。是否还能吃饭

解析：本题考查初诊的目标和内容。是否还能吃饭（E错，为本题正确答案）是初诊时问诊不必涉及的内容。初诊是临床接诊的开始，是一个病史采集的过程，问诊时要准确地获得患者的主诉，即患者就诊的主要原因（A对）和迫切要求解决的问题（B对）；现病史，即主诉疾病的病因（C对）、时间、进程、曾经接收过的检查和治疗（D对）；采集既往史时要侧重了解与本病有关的部分，要询问全身健康状况、营养状况和饮食习惯，对于是否能吃饭是初诊时问诊不必涉及的内容。